脾胃气虚可见
A. 肛门重坠
B. 大便时干时稀
C. 肛门灼热
D. 大便先干后稀
E. 便黑如柏油

正确答案：D。大便先干后稀

解析：若大便先硬后稀，是脾虚。因脾虚运化失职故便溏，而大肠传导不畅则便结（D对）。肛门重坠（A错）见于脾虚气陷或大肠湿热等证。大便时干时稀（B错）属肝郁脾虚。肛门灼热（C错）多因大肠湿热，或热结旁流，热迫直肠所致。便黑如柏油（E错）谓之远血，多见于胃脘等部位出血。